股骨颈内收型骨折pauwels角
A. ＞50
B. 50
C. ＜50
D. ＞30
E. ＜30

正确答案：A。＞50

解析：Pauwels角指的是远端骨折线与两侧髂嵴连线的夹角。根据骨折线的方向，即Pauwels角的大小可将骨折分为内收骨折和外展骨折，其中内收骨折指Pauwels角＞50°（A对），易移位，属于不稳定性骨折；外展骨折指Pauwels角＜30°（E错），不易移位，属于稳定性骨折。